苯胺轻度中毒者，其高铁血红蛋白的含量一般在
A. 10～30%
B. 30～50%
C. 5～15%
D. 15～30%
E. 20%～30%

正确答案：D。15～30%

解析：本题考查苯胺轻度中毒症状。短时间内吸收大量苯胺，可引起急性中毒，主要引起高铁血红蛋白血症。早期表现为发绀，其色调与一般缺氧所见的发绀不同，呈蓝灰色，称为化学性发绀。当血液中高铁血红蛋白含量为血红蛋白总量的15%～30%时（D对ABCE错），即可出现明显发绀，为苯胺轻度中毒的症状，但此时可无自觉症状。